治疗脑血栓形成气虚血瘀证，应首选
A. 大秦艽汤
B. 真方白丸子
C. 补阳还五汤
D. 星蒌承气汤
E. 参附汤

正确答案：C。补阳还五汤

解析：脑血栓形成气虚血瘀证的机理气虚无力行血，则气血壅滞，脉络痹阻、失于气血濡养，发为中风，治疗当补气养血，活血通络，代表方为益气活血通络的补阳还五汤加减（C对）。大秦艽汤（A错）可祛风通络，养血和营，用于治疗脉络空虚，风邪入中证；真方白丸子（B错）可祛风化痰通络，用于治疗风痰淤血，痹阻脉络证；星蒌承气汤（D错）可通腑泻热，化痰理气，用于治疗痰热腑实，风痰上扰证；参附汤（E错）可益气回阳，救阴固脱，用于治疗元气败脱，心神涣散证。